血清淀粉酶（AMS）活性增高最常见于
A. 急性肠胃炎
B. 病毒性肝炎
C. 慢性胆囊炎
D. 急性胰腺炎
E. 病毒性心肌炎

正确答案：D。急性胰腺炎

解析：本题考查的是淀粉酶的临床意义。血清淀粉酶（AMS）活性增高最常见于急性胰腺炎（D对）。淀粉酶（AMY）临床意义：1.活性增高：（1）诊断胰腺炎：①急性胰腺炎是AMY增高的最常见原因；②其他：慢性胰腺炎急性发作、胰腺囊肿、胰腺管阻塞时AMY也可升高。（2）胰腺癌早期AMY增高，是由于肿瘤压迫造成胰腺管阻塞和短时间内大量胰腺组织破坏所致。（3）其他：见于急腹症（病变累及胰腺）、乙醇中毒、肾衰竭（肾排泄AMY减少）。2.活性降低：慢性胰腺炎、胰腺癌分别因胰腺组织严重破坏或胰腺组织纤维化，导致胰腺分泌功能下降。急性胃肠炎（A错）常见于稀糊状或水样粪便。稀糊状或水样粪便的临床意义：常由肠蠕动亢进、水分吸收不充分所致，见于各种肠道感染性或非感染性腹泻，或急性胃肠炎。病毒性肝炎（B错）见于乙肝病毒DNA定性阳性或定量增高。乙肝病毒DNA的临床意义：1.诊断乙型病毒性肝炎的直接依据（定性阳性或定量增高）。2.HBV-DNA阳性是诊断乙肝的佐证，表明HBV复制及有传染性。3.疗效判定（转阴性或定量降低）。4.耐药分析和病毒基因变异检测。病毒性心肌炎（E错）常见于血清CK增高。血清CK的临床意义：血清CK增高：（1）心脏疾病：①CK为早期诊断急性心肌梗死（AMI）的灵敏指标之一。②其他心脏损伤：见于病毒性心肌炎、心脏手术或创伤性心脏介入治疗等。（2）肌肉疾病：如进行性肌萎缩、皮肌炎、急性脊髓灰质炎等。（3）药物性肌损：如服用他汀类药物，或他汀类与贝丁酸类药物联用引起的肌病。（4）其他：如急性脑血管疾病、甲状腺功能减退症，非疾病因素（如剧烈运动）。慢性胆囊炎（C错）时改变的检查项目，2022年考试指南未明确说明。